女，22岁，医学生。最近与男友发生了激烈争执，以致两人分手，情绪极度低落，也十分愤恨，来找学校心理咨询师求帮助。心理咨询师针对其情绪的调节提出的办法中不适合的是
A. 不断宣泄
B. 降低期望
C. 心理应对
D. 改变认知
E. 放松训练

正确答案：A。不断宣泄

解析：调节情绪的方法有：调整行为目标（B对），改变认知评价方式（D对），改变或转换环境，心理防御机制的应用（C对），自我控制与求助（E对），不包括不断宣泄（A错，为本题正确答案）。